早产临产后应慎用的药物是
A. 哌替啶（度冷丁）
B. 利托君（羟苄羟麻黄碱）
C. 沙丁胺醇（舒喘灵）
D. 硫酸镁
E. 地塞米松

正确答案：A。哌替啶（度冷丁）

解析：早产临产后应慎用的药物是哌替啶（度冷丁）（A错，为本题正确答案），此类药物会抑制新生儿呼吸中枢。地塞米松（P60）（E对）属于糖皮质激素类药物，可促进早产儿胎肺成熟。利托君（P61）（羟苄羟麻黄碱）（B对）和沙丁胺醇（舒喘灵）（C对）为β2受体兴奋剂，能够抑制子宫平滑肌收缩；硫酸镁（P61）（D对）可直接作用于子宫平滑肌，拮抗钙离子对子宫收缩活性，均能延长孕周，适用于早产临产。